发挥局部作用的栓剂是
A. 阿司匹林栓
B. 盐酸克伦特罗栓
C. 吲哚美辛栓
D. 甘油栓
E. 双氯芬酸钠栓

正确答案：D。甘油栓

解析：本题考查栓剂。甘油栓（D对）是直肠给药，是发挥局部作用的栓剂；阿司匹林栓（A错）、盐酸克伦特罗栓（B错）、吲哚美辛栓（C错）、双氯芬酸钠栓（E错）均为发挥全身作用的栓剂。